34岁男性，上腹灼痛3个月，柏油样便2日，为了确诊，首选检查是
A. X线钡餐透视
B. 大便隐血试验
C. 血常规
D. 胃镜
E. B超

正确答案：D。胃镜

解析：中年男性患者，上腹灼痛3个月、柏油样便2日（腹痛、黑便为上消化道出血的常见症状），考虑为上消化道出血。为了确诊，首选检查是胃镜（D对）。胃镜不仅能直接观察到出血的部位和出血情况，确定出血病因、取活检，还可对出血病灶进行及时准确的止血治疗。X线钡餐透视（P360）（A错）也可用于上消化道出血，但诊断准确性不如胃镜，主要用于有胃镜禁忌者、不愿接受胃镜检查者和没有胃镜时。大便隐血试验（B错）主要用于明确是否有消化道出血，但不能确定出血部位。血常规（C错）、B超（E错）一般不用于上消化道出血的诊断。